上肢血压增高，且高于下肢血压，最可能的病因是
A. 肾实质病变
B. 肾动脉狭窄
C. 嗜铬细胞瘤
D. 原发性醛固酮增多症
E. 主动脉缩窄

正确答案：E。主动脉缩窄

解析：主动脉缩窄段造成血流阻力增大，缩窄近端血压升高，缩窄远端血供减少，血压降低。主动脉缩窄好发于锁骨下动脉起始点远端的腹主动脉或降主动脉，因此锁骨下动脉支配的上肢血压增高，而下肢由缩窄远端的髂外动脉支配，故血压降低。从而造成上臂血压增高，而下肢血压不高或降低，此为主动脉缩窄的特点（E对）。肾实质病变（A错）引起的高血压的特点为先有严重肾损害，后出现高血压。肾动脉狭窄（B错）常表现为单侧或双侧肾动脉狭窄及继发性高血压，无上肢血压高于下肢血压。嗜铬细胞瘤（C错）典型表现为阵发性血压升高伴心动过速、头痛、出汗、面色苍白，血尿儿茶酚胺显著增高。原发性醛固酮增多症（D错）以长期高血压伴低钾血症为特征。